患儿，5个月。急性腹泻，频繁呕吐2天，检查头颅，可能发现的体征是
A. 囟门逾期不闭
B. 囟门凹陷
C. 囟门高凸
D. 囟门宽大，头缝开解
E. 囟门早闭

正确答案：B。囟门凹陷

解析：患儿急性腹泻，频繁呕吐，会导致丢失体液和摄入量不足，使体液总量尤其是细胞外液量减少，导致不同程度的脱水。患儿则表现为皮肤黏膜干燥，弹性下降，眼窝、囟门凹陷，尿少、泪少，甚则出现四肢发凉等末梢循环改变，故检查头颅，可能发现的体征是囟门凹陷（B对）。囟门逾期不闭（A错）见于佝偻病、先天性甲状腺功能低下症等。囟门高凸（C错）提示颅内压增高。囟门宽大，头缝开解（D错）见于解颅。囟门早闭（E错）见于小头畸形。